患者平素头痛眩晕，突发半身不遂，口舌歪斜，舌强语謇，口苦，尿赤便干，舌红苔黄，脉弦数。治疗应首选
A. 大秦艽汤
B. 补阳还五汤
C. 镇肝熄风汤
D. 苏合香丸
E. 地黄饮子

正确答案：C。镇肝熄风汤

解析：据本病例特点，结合平素头痛头晕病史，故诊断为中风；患者半身不遂、口眼歪斜、语言不利，但意识清楚，故诊断为中经络；肾阴素亏，肝阳上亢，故平素头痛眩晕；风阳内动，挟痰走窜经络，脉络不畅，故突发半身不遂，口舌歪斜，舌强语謇；肾阴亏虚，虚火内生，加之肝火偏旺，灼伤津液，故口苦，尿赤便干；脉弦主肝风；舌红苔黄，脉数系肝肾阴虚而生内热，故其证型为阴虚风动证。肝肾阴虚，风阳内动，治以滋阴潜阳，熄风通络，代表方为镇肝熄风汤（C对）。大秦艽汤，其功用为疏风清热，养血活血，为治疗络脉空虚，风邪入中的选方（A错）。补阳还五汤，其功用为益气养血，化瘀通络，可用于治疗中风之恢复期属于气虚络瘀证(B错)。苏合香丸，其功用为芳香温开通窍，适用于治疗寒闭证及心腹疼痛属于寒凝气滞证（D错）。地黄饮子，其功用为滋肾阴，补肾阳，开窍化痰，可用于治疗颤证之阳气虚衰证（E错）。